测定干燥失重时，若药物的熔点低，受热不稳定或水分难以去除，应采用
A. 常压恒温干燥法
B. 干燥剂干燥法
C. 减压干燥法
D. 比色法
E. 薄层色谱法

正确答案：C。减压干燥法